下列关于暴发的描述错误的是
A. 暴发常由于许多人接触同一致病因子而引起
B. 局部地区或集体单位在较短时间内发生大量同一种疾病称为暴发
C. 一次同源性疾病暴发过程中，大部分病例的发生日期往往在该病的最短和最长潜伏期之间
D. 一次同源性暴发的流行高峰与中位数潜伏期基本
E. 疾病暴发时病例发生日期的不同，是由于该病的传染期不同所致

正确答案：E。疾病暴发时病例发生日期的不同，是由于该病的传染期不同所致